桃仁的功效有
A. 活血祛瘀
B. 理气止痛
C. 止咳平喘
D. 润肺通经
E. 凉血消痈

正确答案：A、C。活血祛瘀；止咳平喘

解析：本题考查的是桃仁的功效。桃仁的功效有活血祛瘀（A对）、止咳平喘（C对）。桃仁：【性能特点】本品苦能泄降，甘润多脂，性平不偏。主入心、肝经，破血祛瘀而通经（D错）、生新血，为治血瘀诸证之要药；并入肺、大肠经，能润肺降气、润燥滑肠而止咳平喘、通便，为治燥秘、肠痈、肺痈、咳喘所常用。因其活血力强，凡血瘀不论寒热新久皆宜，兼咳喘者尤佳。治咳喘、肠燥不论兼瘀与否、不论寒热皆可选用。【功效】活血祛瘀，润肠通便，止咳平喘。香附：【功效】疏肝理气，调经止痛（B错）。丹参：【功效】活血祛瘀，通经止痛，清心除烦，凉血消痈（E错）。